医生在体格检查时遵循的道德要求是
A. 全面系统，频换体位
B. 动作要敏捷，手法要轻柔，我行我素
C. 偶遇不合作或拒绝检查的患者时要说服患者进行检查或者易诊检查
D. 方法简单方便
E. 尊重患者，心正无私

正确答案：E。尊重患者，心正无私